一患者急需接受骨髓移植，但无合适供体。已知发生骨髓移植排斥反应的一个主要原因是配型不合供体骨髓中存在着成熟的T淋巴细胞。为了减轻排斥反应，在移植前，可用补体加抗体处理配型不合的供体骨髓。在这种情况下，所应用的抗体应能识别
A. CD3
B. CD4
C. CD8
D. CD28
E. CD154

正确答案：A。CD3